在下述指标中，有利于避免营养缺乏病和营养过剩性疾病，膳食结构基本合理的是
A. 经济发达国家膳食模式
B. 日本膳食模式
C. 东方膳食结构模式
D. 地中海膳食模式
E. 我国膳食模式

正确答案：B。日本膳食模式